用放血法治疗昏迷的穴位是
A. 天枢
B. 十宣
C. 大椎
D. 血海
E. 委中

正确答案：B。十宣

解析：十宣（B对）浅刺0.1-0.2寸，或点刺出血可治疗昏迷。天枢（A错）主治胃肠疾病；大椎（C错）主治高热，感冒、咳嗽，头项僵痛，风疹、痤疮；血海（D错）主治瘀血疼痛，风疹瘙痒；委中（E错）主治腰背痛、腹痛、急性腹泻、丹毒。